虚热证的面色表现是
A. 满面通红
B. 两颧潮红
C. 面青颊赤
D. 面黄晦暗
E. 面赤如妆

正确答案：B。两颧潮红

解析：午后两颧潮红，为虚热证，因阴虚阳亢，虚火上炎所致，在内伤久病，如肺痨病等患者中可见到（B对）。满面通红、目赤，为实热证，因热性炎上，血行加速而充盈于面，可见于脏腑火热炽盛或外感邪热亢盛患者（A错）。面青颊赤，为寒热往来之少阳病（C错）。黄而晦暗如烟熏者，这是阴黄，多因寒湿困阻而成（D错）。久病、重病患者面色苍白，却时而颧赤泛红如妆、游移不定，这是戴阳证。多由久病阳气虚衰，阴寒内盛，阴盛格阳，虚阳浮越所致，属真寒假热之证，多见于久病脏腑阳气极度衰竭患者，为病情危重征象（E错）。